碳酸锂用于
A. 抗惊厥
B. 抗癫痫
C. 抗躁狂
D. 抗焦虑
E. 抗抑郁

正确答案：C。抗躁狂